卫生服务不包括
A. 拥有促进健康、预防疾病、治疗和康复等服务健全的卫生机构
B. 保证服务的可及性
C. 完备和质量保证的服务网络
D. 个人的心理行为状态
E. 公平合理的卫生资源配置

正确答案：D。个人的心理行为状态

解析：本题考查预防医学概论、健康及三级预防策略。卫生服务不包括个人的心理行为状态（D错，为本题正确答案）。卫生服务：包括拥有促进健康、预防疾病、治疗和康复等服务健全的卫生机构（A对），完备和质量保证的服务网络（C对），一定的经济投入和公平合理的卫生资源配置（E对），以及保证服务的可及性（B对）。